是一种间接的、迂回的方式为
A. 会谈法
B. 观察法
C. 作品分析法
D. 心理测验法
E. 调查法

正确答案：E。调查法

解析：调查法：调查的含义是当有些资料不可能从当事人那里获得时，就要从相关的人或材料那里得到。因此，调查是一种间接的、迂回的方式。掌握“心理评估概述”知识点。